目前认为志贺菌致病必须具备的条件是
A. 过度劳累
B. 暴饮暴食
C. 细菌变异性
D. 痢疾杆菌对肠黏膜上皮细胞的侵袭力
E. 发病季节

正确答案：D。痢疾杆菌对肠黏膜上皮细胞的侵袭力

解析：目前认为志贺菌致病必须具备的条件是痢疾杆菌对肠黏膜上皮细胞的侵袭力（D对），志贺菌侵袭并生长在结肠黏膜上皮细胞，经基底膜进入固有层，并在其中繁殖、释放毒素，引起炎症反应和小血管循环障碍。其他致病因素还包括细菌数量和人体抵抗力。过度劳累（A错）、暴饮暴食（B错）可影响机体的抵抗力；细菌变异性（C错）可影响致病力；发病季节（E错）的发病率高于其他季节，以上均与志贺菌致病相关，但不是志贺菌致病的必须条件。